下列关于土壤卫生叙述哪一项是错误的
A. 土壤有吸附和过滤作用，有利于土壤的自净
B. 有机物无机化和腐殖质化是土壤有机物自净的主要途径
C. 环境条件改变，生物间拮抗作用使土壤中病原体死亡
D. 土壤中化学污染物（重金属、农药）多数化学性质稳定，不易降解
E. 土壤固体污染物污染范围比较局限，但可通过风吹、雨水淋溶冲刷而扩大污染范围

正确答案：A。土壤有吸附和过滤作用，有利于土壤的自净